女性，46岁，左乳头刺痒，伴乳晕、发红糜烂3月，查体双侧腋窝无肿大淋巴结，乳头分泌物涂片细胞学检查见癌细胞。该病人癌变的类型是
A. 乳头湿疹样癌
B. 髓样癌
C. 鳞状细胞癌
D. 粘液细胞癌
E. 大汗腺样癌

正确答案：A。乳头湿疹样癌

解析：该病人癌变的类型是乳头湿疹样癌（A对）。本病一般表现为皮肤变粗糙、糜烂如湿疹样，进而形成溃疡，本病发展慢，恶性程度低，腋窝淋巴结转移发生较晚。髓样癌（B错）的癌细胞呈片状或巢状，间质成分少于1/3；乳腺罕见鳞状细胞癌（C错）；粘液细胞癌（D错）癌实质中上皮粘液成分占一半以上；大汗腺样癌（E错）癌细胞体积大，呈柱状，主、间质常明显分离。以上四种分型均需通过病理学检查方能区别，其临床表现无特异性。